人体内属于可逆反应的是
A. 异柠檬酸→α-酮戊二酸
B. 草酰乙酸→柠檬酸
C. α-酮戊二酸→琥珀酰COA
D. 磷酸烯醇式丙酮酸→丙酮酸
E. 葡萄糖→6-磷酸葡萄糖

正确答案：C。α-酮戊二酸→琥珀酰COA

解析：糖有氧氧化中的不可逆反应分别是：葡萄糖—6-磷酸葡萄糖（E错）、果糖-6-磷酸—果糖-1，6-二磷酸、磷酸烯醇式丙酮酸—丙酮酸（D错）、丙酮酸—乙酰辅酶A、草酰乙酸—柠檬酸（B错）、异柠檬酸—α-酮戊二酸（A错）、α-酮戊二酸—琥珀酰CoA（C错）。所以本题没有正确答案，原给出的参考答案是C。